同一药物相同剂量的试验制剂AUC与参比制剂AUC的比值称为
A. 消除率
B. 速率常数
C. 生物半衰期
D. 绝对生物利用度
E. 相对生物利用度

正确答案：E。相对生物利用度

解析：本题考查相对生物利用度。相对生物利用度（E对）是试验制剂的AUC与参比制剂的AUC之比；清除率（A错）是单位时间内从体内消除的含药血浆体积；速率常数（B错）为药物在体内反应速度与浓度的关系；t1/2为生物半衰期（C错）；绝对生物利用度（D错）是参比制剂的AUC与静脉注射给药的AUC之比。